对青霉素G无效的病菌为
A. 革兰阳性球菌
B. 革兰阳性杆菌
C. 革兰阴性球菌
D. 铜绿假单胞菌
E. 梅毒螺旋体

正确答案：D。铜绿假单胞菌